突发公共卫生事件是指突然发生，造成或者可能造成社会公众健康严重损害的重大
A. 领导责任事件
B. 群体不明原因疾病的事件
C. 医疗机构事故
D. 社会治安事件
E. 消防安全事件

正确答案：B。群体不明原因疾病的事件

解析：国境口岸突发公共卫生事件，是指突然发生，造成或可能造成出入境人员和国境口岸公众健康严重损害的重大传染病疫情、群体性不明原因疾病（B对ACDE错）、重大食物中毒以及其他严重影响公众健康的事件。